一个测验工具中对于对象可以测量到的真实程度，是指该工具的
A. 常模
B. 信度
C. 效度
D. 样本
E. 标准

正确答案：C。效度

解析：标准化心理测验的技术指标主要有信度、效度及常模等。效度指一个测量工具能够测量出其所要测东西的真实程度。它反映工具的有效性、正确性（C对）。信度（B错）是指一个测验工具在对同一对象的几次测量中所得结果的一致程度，它反映工具的可靠性和稳定性。常模（A错）是指某种测验在某种人群中测查结果的标准量数，即可比较的标准。样本（D错）是指研究中实际观测或调查的一部分个体。